突发耳鸣，声大如潮声，按之不减者，多因
A. 肝胆火盛
B. 阴虚火旺
C. 肝肾阴虚
D. 肾精亏损
E. 气血不足

正确答案：A。肝胆火盛

解析：耳鸣是指患者自觉耳内有响声如潮水或蝉鸣的症状。突发耳鸣，声大如雷，按之尤甚，属实证。多由肝胆火扰（A对）、肝阳上亢，或药毒损伤耳窍等所致。渐起耳鸣，声细如蝉，按之可减，或耳渐失聪而听力减退者，多属虚证。可因肾精亏虚（D错），或脾气亏虚，清阳不升，或肝阴、肝血不足，髓海失充，耳窍失养所致。